失代偿性呼吸性酸中毒
A. pH7.38，PaO₂50mmHg，PaCO₂42mmHg
B. pH7.30，PaO₂50mmHg，PaCO₂82mmHg
C. pH7.40，PaO₂60mmHg，PaCO₂67mmHg
D. pH7.35，PaO₂80mmHg，PaCO₂22mmHg
E. pH7.25，PaO₂70mmHg，PaCO₂32mmHg

正确答案：B。pH7.30，PaO₂50mmHg，PaCO₂82mmHg

解析：机体通过肺、肾来维持酸碱平衡，这是一个动态平衡的过程。当发生呼吸性酸中毒时，机体通过肾脏的排酸保碱功能来维持血液pH的稳定。本题为失代偿性呼吸性酸中毒，说明机体已经不能通过肾脏代谢来代偿原发的呼吸性酸中毒，因此pH＜7.35（ACD错），呼吸性酸中毒患者PaCO₂增高＞45mmHg（ADE错）。所以本题只有pH7.30，PaO₂50mmHg，PaCO₂82mmHg（B对ACDE错）符合失代偿性呼吸性酸中毒的指标。